某初中生，特别喜欢玩电子游戏，也常常因贪玩完不成作业而叹息，但就是管不住自己，这表明他的
A. 情绪不稳定
B. 兴趣太广泛
C. 耐受力差
D. 自制力差
E. 理智感差

正确答案：D。自制力差

解析：文中的电子游戏对初中生来说是外界的诱惑，因为贪玩而不能按时完成作业，这说明他不能约束自己的行为来执行已确定的计划，是自制力差的表现（D对）。耐受力（P28）（C错）是指人对环境的变化能保持良好的适应，面对各种应激时间能有较强的承受能力的品质，文中的男孩只是面对诱惑不能自控，没有提到面对困难而屈服的事情。理智感（P25）（E错）是指人们在认识和评价事物过程中产生的情感，是人们学习科学知识，认识掌握事物发展规律的动力，例如求知欲和好奇心等。